基因诊断及治疗的伦理原则应除外
A. 尊重病人的原则
B. 知情同意的原则
C. 有益于病人的原则
D. 保守秘密的原则
E. 创新至上的原则

正确答案：E。创新至上的原则